关于IgE下列哪项错误
A. IgE的H链有4个CH区
B. 是正常人血清含量最少的Ig
C. IgE无绞链区
D. 寄生虫感染使IgE水平降低
E. 在个体发育过程中开始合成时间较晚

正确答案：D。寄生虫感染使IgE水平降低